男，30岁。1小时前从3米高处坠落，右腰部受伤，局部疼痛，肉眼血尿。查体：生命体征平稳，腹软。住院5日后下床活动，右腰部疼痛加剧并出现腰部包块。此时P120次/分，BP80/40mmHg。下一步最恰当的治疗措施是
A. 抗休克同时准备手术
B. 输血
C. 抗感染
D. 输液
E. 继续观察

正确答案：A。抗休克同时准备手术

解析：青年男性患者，右腰部受伤后，出现局部疼痛和肉眼血尿（肾脏损伤的表现），应考虑右肾损伤。由于患者当时生命体征平稳，腹软，故最可能的诊断为肾部分裂伤（肾挫伤血尿不明显；肾全层裂伤出血多，常伴休克；肾蒂血管损伤常死于现场）。肾部分裂伤患者需绝对卧床休息2～4周，过早离床活动，有可能再度出血。患者5日后下床活动，右腰部疼痛加剧并出现腰部包块，P120次/分，BP80/40mmHg，提示肾有再度出血或肾周血肿破裂，故此时最恰当的治疗措施为积极补液、输血等抗休克治疗，同时准备手术探查止血（A对）。单纯输血（B错）、输液（D错）仅能短期缓解休克的症状，无法从根本上解决引起失血的原因。继续观察（E错）和抗感染（C错）治疗均为患者的辅助治疗措施，不是当前最主要的治疗措施。